以下关于桩冠外形的描述，正确的是
A. 圆形
B. 直径为根径的1/2
C. 与根管壁不宜太密合，以利就位
D. 与根部外形一致
E. 从根管口到根尖为圆柱状

正确答案：D。与根部外形一致

解析：本题考查桩核冠的设计。关于桩冠外形的描述正确的是与根部外形一致（D对）。由于根管与根外形相似，因此桩在各个横切面上形态可参照牙根外形。若不考虑牙根形态，使用圆形（A错）、从根管口到根尖为圆柱状（E错）的桩，磨除过多的根管壁，会导致根管侧穿或根折。桩的直径取决于根管直径和根径的大小，理想桩的直径为根径的1/3（B错）。与根管壁要密合（C错），增加摩擦力利于固位。